再次免疫应答产生的主要抗体是
A. IgG
B. IgM
C. IgD
D. IgE
E. IgA

正确答案：A。IgG